男性，52岁，因咳嗽、胸闷、气短1周收入住院。查体：T37.5℃，R24次/分，口唇发绀，左锁骨上可触及一花生米大之淋巴结，质硬，固定无压痛，气管向左侧移位，右肺叩诊呈浊音，语颤明显减弱，呼吸音消失。胸液常规示蛋白含量35g/L，WBC850×10⁶/L，N20%，L80%，细胞学见大量淋巴细胞。LDH800U/L，PPD（+）。最可能的诊断是
A. 右侧大叶性肺炎
B. 右侧结核性胸膜炎
C. 右侧恶性胸腔积液
D. 右侧化脓性胸腔积液
E. 右侧漏出性胸腔积液

正确答案：C。右侧恶性胸腔积液

解析：患者为中老年男性，胸液常规示蛋白含量35g/L，WBC850×10⁶/L，N20％，L80％，提示为渗出性胸水（渗出性胸水化验一般表现为：WBC＞500×10⁶/L，比重＞1.018，胸水蛋白质＞30g/L），而非漏出性胸水（E错）。细胞学见大量淋巴细胞，LDH800U/L，左锁骨上可触及一花生米大之淋巴结，质硬固定无压痛，提示为恶性胸腔积液（LDH＞500U/L，则为恶性胸腔积液）（C对）。大叶性肺炎（A错）、化脓性胸水（D错）可导致渗出性胸水，但一般没有左锁骨上淋巴结肿大，表现为白细胞计数和中性粒细胞比例升高，而不是淋巴细胞比例升高。结核性胸水（B错）可表现为渗出液，以淋巴细胞为主，但是左锁骨不会出现质硬固定无压痛的淋巴结，LDH均在200～500U/L之间，不符合本例患者检查结果，故不考虑此两项诊断，PPD试验阳性仅对儿童、少年和青年的结核病诊断有参考意义，故仍可排除结核性胸膜炎。